注射破伤风抗毒素是
A. 自然自动免疫
B. 自然被动免疫
C. 人工自动免疫
D. 人工被动免疫
E. 被动自动免疫

正确答案：D。人工被动免疫

解析：本题考查人工被动免疫。人工被动免疫是将含有特异性抗体的血清或制剂接种人体，使机体被动地获得特异性免疫力而受到保护。注射破伤风抗毒素是人工被动免疫（D对ABCE错）。